临床治疗药物监测常用的标本是
A. 脏器
B. 组织
C. 血浆
D. 汗液
E. 唾液

正确答案：C。血浆

解析：本题考查体内药物检测。临床治疗药物监测常用的标本是血浆（C对）。血液能够较为准确地反映药物在体内的状况，可检测药物的血药浓度及药物在靶器官的状况。脏器（A错）和组织（B错）只有在特定情况下进行监测。汗液（D错）不属于药物监测标本。唾液（E错）不一定与药物浓度有相关性，取决于药物使用部位和使用方法。